有关肋间动脉的描述，正确的是
A. 第3-11对肋间后动脉发自主动脉胸部
B. 第1-2对肋间动脉发自肋颈干
C. 胸廓内动脉的肋间支分布于肋间隙前部
D. 肋间后动脉主干行于肋沟内
E. 以上全对

正确答案：E。以上全对

解析：第3-11对肋间后动脉发自主动脉胸部，肋间后动脉主干行于肋沟内，第1-2对肋间动脉发自肋颈干，胸廓内动脉的肋间支分布于肋间隙前部（ABCD对，故E为本题正确答案）。